脑出血的诊断依据是
A. 争吵后头痛呕吐
B. 偏瘫偏盲偏身感觉障碍
C. 急性偏瘫者，伴CT中对应区域有低密度灶
D. 急性偏瘫者，伴CT中对应区域有高密度灶
E. 持续昏迷者

正确答案：D。急性偏瘫者，伴CT中对应区域有高密度灶

解析：脑出血的临床诊断主要依据患者在活动中或情绪激动时突然起病，并出现相应的颅内压增高表现，头颅CT检查显示高密度灶，故急性偏瘫者，伴CT中对应区域有高密度灶（D对）可诊断为脑出血。争吵后头痛呕吐（A错）只能考虑脑出血导致颅内压增高的可能，而不能确诊为脑出血。偏瘫偏盲偏身感觉障碍（B错）即“三偏”综合征，可见于可以导致完全性内囊损害的任何疾病。急性偏瘫者，伴CT中对应区域有低密度灶（C错）主要见于脑梗塞。持续昏迷者（E错）可见于中毒等众多全身性疾病及肝性脑病、肺性脑病、尿毒症等代谢性疾病。